患者有病毒性心肌炎病史，现心悸怔忡，胸闷或胸痛，气短乏力，失眠多梦，自汗盗汗，舌质红，苔薄或少苔，脉细数无力或促、结代。其中医治法是
A. 解毒化湿，宁心安神
B. 清热解表，养血宁心
C. 益气养阴，宁心安神
D. 益气温阳，滋阴通脉
E. 清热解毒，宁心安神

正确答案：C。益气养阴，宁心安神

解析：本题患者病毒性心肌炎，心气不足，鼓动乏力，则心悸怔仲，心居胸中，心气亏虚，胸中宗气运转无力，则胸闷气短，心神失养则乏力。心阴不足，心失所养，心神不安则失眠多梦。阴虚阳亢，虚热内生则自汗盗汗，舌质红，少苔，脉细数无力或促结代为气阴两虚之象，所以宜益气养阴，宁心安神（C对）；解毒化湿，宁心安神用于湿毒犯心证，症见发热，微恶寒，恶心欲呕，腹胀腹痛，大便稀溏，困倦乏力，口渴，心悸，胸闷或隐痛，舌红苔黄腻，脉濡数或促、结、代（A错）；清热解表，养血宁心症见：咳嗽，痰黄粘稠难出，胸痛烦闷，心悸气短，身热汗出，口渴，小便黄赤，大便干结。舌红苔黄，脉沉弦（B错）；益气温阳，滋阴通脉用于阴阳两虚证，症见心悸气短，胸闷或痛，面色晦暗，口唇发绀，肢冷畏寒，甚则喘促不能平卧，咳嗽，吐痰涎，夜难入寐，浮肿，大便稀溏，舌淡红，苔白，脉沉细无力或促、结、代（D错）；清热解毒，宁心安神用于热毒侵心证，症见发热微恶寒，头身疼痛，鼻塞流涕，咽痛口渴，口干口苦，小便黄赤，心悸气短，胸闷或隐痛，舌红苔薄黄，脉浮数或结代（E错）。